男孩，14岁，进行性开口困难7年，面部明显不对称。临床检查已完全不能张口。5岁时曾发生颏部对冲性损伤。该病最可能的诊断是
A. 咀嚼肌痉挛
B. 颞下颌关节强直
C. 破伤风后遗症
D. 癔症性开口困难
E. 颞下颌关节紊乱病

正确答案：B。颞下颌关节强直

解析：既往有颏部对冲伤史。发生严重的张口困难，伴发面部畸形者，颞下颌关节强直的可能性最大。掌握“颞下颌关节强直”知识点。